宜于睡前服用的药品是
A. 呋塞米
B. 普伐他汀
C. 甲氧氯普胺
D. 格列美脲
E. 阿司匹林

正确答案：B。普伐他汀

解析：本题考查药品服用的适宜时间。普伐他汀（B对）为调节血脂药，肝脏合成胆固醇高峰期多在夜间，晚餐后服药有助于提高疗效。呋塞米（A错）为利尿药，宜于清晨服用。甲氧氯普胺（C错）为促胃动力药，餐前服用利于助消化。格列美脲（D错）为降糖药，适合餐中服用。阿司匹林（E错）为非甾体抗炎药，宜于餐后服用。